男，45岁。自幼年起反复发作咳喘，咳喘常于春季发作，发作时伴有咳少量白痰，症状均于休息数日后自行缓解。3天前受凉后咳喘再次发作，逐渐加重。动脉血气分析：pH7.43，PaCO₂35mmHg，PaO₂55mmHg。下列处理措施中不正确的是
A. 静脉点滴糖皮质激素
B. 无创通气
C. 静脉补液
D. 吸氧使SpO₂维持在90%以上
E. 联合使用支气管舒张剂

正确答案：B。无创通气

解析：患者自幼年起反复发作咳喘，常于春季发作，症状自行缓解，3天前受凉后咳喘再次发作（哮喘典型特点）。可采取的处理有：静脉点滴糖皮质激素（A对）、静脉补液（C对）、吸氧使SpO₂维持在90%以上（D对）、联合使用支气管舒张剂（E对），但患者PaCO₂35mmHg，不符合无创通气（B错，为本题正确答案）的PaCO₂≥45mmHg这一指征。